根据《药品流通监督管理办法》，销售药品时应提供加盖本企业原印章的《药品经营许可证》复印件的是
A. 药品生产企业
B. 药品批发企业
C. 药品零售企业
D. 医疗机构
E. 计划生育技术服务机构

正确答案：B。药品批发企业

解析：本题考查的是药品批发企业药品经营活动。根据《药品流通监督管理办法》，销售药品时应提供加盖本企业原印章的《药品经营许可证》复印件的是药品批发企业（B对）。药品批发企业药品经营活动：药品批发企业购进药品，应当建立并执行进货检查验收制度，索取、查验、留存《药品经营监督管理办法》规定的供货企业及其授权委托销售人员有关证件资料、销售凭证（保存至超过药品有效期1年，且不得少于5年），在验明药品合格证明和其他标识等证明药品合法性材料后方可购进、销售；不符合规定的，不得购进和销售。药品批发企业应当严格审核药品购货单位资质，按照其药品生产范围、经营范围或诊疗范围向其销售药品。销售药品时，药品批发企业向购进单位提供以下资料：①药品上市许可持有人证明文件（或药品生产许可证、药品经营许可证）和营业执照的复印件；②所销售药品批准证明文件和检验报告书的复印件；③企业派出销售人员授权书复印件；④标明供货单位名称、药品通用名称、上市许可持有人、生产企业、产品批号、产品规格、销售数量、销售价格、销售日期等内容的凭证；⑤销售进口药品的，按照国家有关规定提供相关证明文件。上述资料均应当加盖本企业公章，通过网络核查、电子签章等方式确认的电子版具有同等效力。药品批发企业从事购进、储存、运输、销售药品等药品经营活动应当持续符合药品GSP的要求。